男，21岁。右侧颈部受击伤后昏迷30分钟，清醒5小时后又转入昏迷，伴右侧瞳孔放大，左侧肢体瘫痪。首先考虑的诊断是
A. 脑干损伤
B. 左侧脑内血肿
C. 右侧脑挫伤
D. 右侧急性硬脑膜外血肿
E. 右侧急性硬脑膜下血肿

正确答案：D。右侧急性硬脑膜外血肿

解析：青年患者，右侧颈部受击伤后，昏迷-中间清醒-昏迷（硬膜外血肿的特征性症状），伴右侧瞳孔放大（提示血肿位于右侧），左侧肢体瘫痪，根据患者的临床症状及体征，考虑最可能的诊断为右侧急性硬脑膜外血肿（D对），硬膜下血肿（E错）多表现为持续昏迷或昏迷进行性加重，且瞳孔变化出现晚。脑干损伤（A错）表现为病灶侧脑神经周围性瘫痪和对侧肢体中枢性瘫痪及感觉障碍。